下列哪项不属于皮肤作痒的病因
A. 风
B. 湿
C. 热
D. 血瘀
E. 虫毒

正确答案：D。血瘀

解析：痒是皮肤病主要的自觉症状，辨痒发生的原因主要有以下五个方面。风胜（A对）则走窜无定，遍体作痒，抓破血溢，随破随收，不致化腐，多为干性。如牛皮癣、白疙、瘾疹等。湿胜（B对）则浸淫四窜，黄水淋漓，易沿表皮蚀烂，越腐越痒，多为湿性，或有传染性。如急性湿疮；或有传染性，如脓疱疮等。热胜（C对）则皮肤瘾疹，掀红灼热作痒，或只发于暴露部位，或遍布全身，甚则糜烂，滋水，淋漓，结痂成片，常不传染，如接触性皮炎。虫淫，即虫毒（E对）则浸淫蔓延，黄水频流，状如虫行皮中，其痒尤甚，最易传染，如手足癣、疥疮等。血虚 皮肤变厚、干燥、脱屑、作痒，很少糜烂滋水，如牛皮癣、慢性湿疮（D错，为本题正确答案）。